有易兴奋症的精神-神经症状、口腔炎和震颤等主要表现的职业中毒最可能的是
A. 慢性汞中毒
B. 慢性铅中毒
C. 慢性苯中毒
D. 慢性砷中毒
E. 慢性锰中毒

正确答案：A。慢性汞中毒